男，40岁，农民。以高热伴食欲明显减退、呕吐2周入院。实验室检查：WBC3.2×10⁹/L，嗜酸性细胞0。为该患者做了肥达试验，下列解释正确的是
A. H效价不高、O效价增高提示是非特异性回忆反应
B. O效价不高、H效价增高提示伤寒杆菌感染
C. O效价不高、H效价增高提示与其他沙门菌间的交叉反应
D. H效价不高、O效价增高提示是预防接种的结果
E. O和H效价均增高有助于伤寒的诊断

正确答案：E。O和H效价均增高有助于伤寒的诊断

解析：回忆反应，有特异性和非特异性两种，前者是在初次免疫的基础上，若在抗体下降期再次以同样抗原刺激，则发现潜伏期明显缩短，抗体效价大幅度上升，而且持续时间很长；后者是指当机体受到不同抗原刺激时，可引起另一种抗体上升，上升效价低且很快下降的现象。O抗原，即菌体抗原，同种细菌中O抗原基本相同，所以肥达试验只用了一种O抗原，O抗体主要是IgM，出现较早；H抗原，即鞭毛抗原，在伤寒副伤寒中H抗原均不同，可用来鉴别诊断伤寒、副伤寒，H抗体主要是IgG，出现较晚。根据此特点，现将肥达试验结果诊断价值总结如下：1、二者均超过正常值，则伤寒的可能性大（E对）；2、二者均在正常范围内，患伤寒可能性小；3、H抗体效价超过正常值，O抗体效价正常，可能是接种了伤寒疫苗或者是接种的回忆反应（BC错）；4、O抗体效价超过正常值，H抗体效价正常，可能是伤寒早期或其他沙门氏菌感染（AD错）；5、试验必须动态观察，一般5～7天复查一次，效价逐渐升高，辅助诊断意义也随着升高。